下列细胞中，能分泌降钙素的是
A. 甲状腺滤泡细胞
B. 甲状旁腺细胞
C. 腺垂体细胞
D. 神经垂体细胞
E. 甲状腺滤泡旁细胞

正确答案：E。甲状腺滤泡旁细胞

解析：降钙素（CT）由甲状腺C细胞（或称滤泡旁细胞）（E对）分泌。甲状腺滤泡细胞（A错）（P389）分泌甲状腺过氧化物酶。甲状旁腺细胞（B错）（P398）分泌甲状旁腺激素。腺垂体细胞（C错）（P370）分泌多种激素如生长激素、催乳素、促甲状腺激素、促肾上腺皮质激素、卵泡刺激素和黄体生成素等。神经垂体细胞（D错）（P385）分泌血管升压素和缩宫素。